最能反映小儿近期营养状态变化的指标
A. 身高
B. 体重
C. 胸围
D. 腹围
E. 头围

正确答案：B。体重

解析：营养不良主要见于3岁以下儿童，随着营养不良的时间及程度，依次表现为：体重不增、体重下降（B对），皮下脂肪减少或消失（依次腹部、躯干、臀部、四肢面颊），脏器功能下降、代谢异常。身高（A错）只有在严重营养不良，骨骼生长减慢时，才会低于正常；营养不良时，胸围（C错）、腹围（D错）、头围（E错）三个指标的异常均与皮下脂肪消耗以及肌肉分解有关，故其不能早期反映小儿营养状况。